炙甘草汤的功用是
A. 渗湿
B. 通便
C. 升阳举陷
D. 补血
E. 疏肝

正确答案：D。补血

解析：炙甘草汤方中重用生地黄为君药，滋阴养血。臣以炙甘草益气养心；麦门冬滋养心阴；桂枝温通心阳，与生地黄相伍，可收气血阴阳并补之效。佐以人参补中益气；阿胶滋阴养血；麻仁滋阴润燥；大枣益气养血；生姜辛温，具宣通之性，合桂枝以温通阳气，配大枣益脾胃以滋化源、调阴阳、和气血。诸药配伍，使阴血足而血脉充，阳气旺而心脉通，气血充足，阴阳调和（D对）。参苓白术散的功用是渗湿（A错）。麻子仁丸的功效有通便（B错）。补中益气汤有升阳（C错）举陷的功效。逍遥散有疏肝（E错）的功效。